乳牙中患龋最少的是
A. 下颌乳磨牙
B. 上颌乳磨牙
C. 上颌乳前牙
D. 下颌乳前牙
E. 乳牙中各牙患龋情况相差不大

正确答案：D。下颌乳前牙

解析：本题考查乳牙龋病的好发牙位。乳牙中患龋最少的是下颌乳前牙（D对）。乳牙列中患龋率由高到低的排列顺序为下颌第二乳磨牙（A错）、上颌第二乳磨牙、第一乳磨牙（B错）、上颌乳前牙（C错）、下颌乳前牙。乳牙中各牙患龋情况差别比较明显（E错）。